患儿6岁半，左侧上颌第一乳磨牙早失，且全口龋齿前来就诊，在治疗全口龋齿的过程中还应重点考虑
A. 检查软组织
B. 检查牙齿松动度
C. 检查牙齿萌出情况
D. 进行间隙保持
E. 考虑是否进行修复治疗

正确答案：D。进行间隙保持

解析：此题重点考察乳磨牙早失的相关内容。乳磨牙早失中第二乳磨牙早失发生间隙狭窄的情况较第一乳磨牙早失常见，但是在上颌第一乳磨牙早失可能影响恒尖牙的萌出。所以多数学者认为第一乳磨牙在8岁以前、第二乳磨牙在9岁以前早失应做间隙保持器。掌握“乳牙早失及间隙管理”知识点。